细胞内合成氨基酰tRNA时消耗
A. ATP
B. CTP
C. GTP
D. UTP
E. TTP

正确答案：A。ATP